关于必需脂肪酸与非必需脂肪酸的正确叙述是
A. 前者是人体所必需的，而后者不是
B. 前者可以在人体合成，而后者不能
C. 前者不能在人体合成，而后者可以
D. 前者不必由食物提供，而后者必须
E. 前者作用大，后者作用小

正确答案：C。前者不能在人体合成，而后者可以